以下哪项不是根管治疗对牙齿的影响
A. 牙齿脆性增加
B. 牙齿抗力减小
C. 牙周组织萎缩
D. 牙齿易崩解
E. 牙齿颜色可能发生改变

正确答案：C。牙周组织萎缩

解析：充分了解根管治疗对牙体组织的影响：①失去牙髓的牙齿脆性增加；②根管治疗使牙齿抗力减小；③根管治疗后牙齿颜色可能发生改变。掌握“疗效评定与牙体修复原则”知识点。